不会传播结核病的患者是
A. 痰涂片阳性结核患者
B. 痰培养阳性结核患者
C. 潜隐感染结核患者
D. 活动性结核患者
E. 复燃结核患者

正确答案：C。潜隐感染结核患者